患者，女，54岁。面色㿠白，时自汗出，恶风，经常患感冒，脉浮无力，用黄芪配伍哪几味药物治疗为佳
A. 党参、白术
B. 党参、茯苓
C. 党参、甘草
D. 白术、防风
E. 白术、茯苓

正确答案：D。白术、防风

解析：面色㿠白，时自汗出，恶风，经常患感冒，脉浮无力，为卫阳虚衰，卫表不固的表现，黄芪能够益气固表止汗，白术、防风能补气固表，祛风散邪（D对ABCE错）。